心下有痰饮，胸胁支满，目眩者，宜用
A. 肾气丸
B. 苓桂术甘汤
C. 小半夏加茯苓汤
D. 小青龙汤
E. 泽泻汤

正确答案：B。苓桂术甘汤

解析：心下，即胃之所在，故此当属狭义痰饮证。饮停中州，阻碍气机，浊阴不降，弥漫于胸胁则支撑胀满；清阳不升，浊阴上蒙清窍则头昏目眩。病机属脾 胃阳虚，痰饮中阻。治用苓桂术甘汤温阳化饮，健脾利水（B对）。方中茯苓淡渗利水。化饮降浊。为治饮病之要药，桂枝辛温通阳，振奋阳气以消饮邪，两药合用，可温阳化饮；白术健脾燥湿，甘草和中益气，两药相伍，补土制水。本方是温阳化饮的主要方剂，亦是“温药和之”的具体运用。